以下不属于杀伤细胞免疫球蛋白样受体的是
A. KIR3DL
B. KIR2DL
C. KIR2DS
D. KIR3DS
E. KIR4DS

正确答案：E。KIR4DS

解析：杀伤细胞免疫球蛋白样受体（KIR）有KIR3DL、KIR2DL、KIR2DS、KIR3DS几种类型。掌握“NK细胞、抗原提呈及其他免疫细胞”知识点。